男，30岁。十二指肠溃疡3年，8小时前突发上腹部疼痛。查体：全腹肌紧张，压痛反跳痛（+）。立位腹部X线平片示右侧膈下游离气体。继发感染的常见细菌是
A. 金黄色葡萄球菌
B. 变形杆菌
C. 肺炎克雷伯杆菌
D. 大肠埃希菌
E. 铜绿假单胞菌

正确答案：D。大肠埃希菌

解析：青年男性患者，有十二指肠溃疡病史，突发上腹疼痛，腹部有压痛、反跳痛及腹肌紧张（腹膜刺激症状），立位腹部X线平片示右侧膈下游离气体（提示溃疡穿孔），结合患者病史、体查和影像学检查，应诊断为急性十二指肠溃疡穿孔。十二指肠溃疡穿孔继发感染后可引起急性腹膜炎，其最常见致病菌为大肠埃希菌（D对），其次为变形杆菌（B错）、肺炎克雷伯杆菌（C错）和铜绿假单胞菌（E错），金黄色葡萄球菌（A错）极少见。